气血亏虚所致眩晕的主要特征有
A. 动则加剧，神疲乏力
B. 劳累即发，心悸少寐
C. 日久不愈，腰酸膝软
D. 胸闷恶心，视物旋转
E. 倦怠懒言，唇甲不华

正确答案：A、B、E。动则加剧，神疲乏力；劳累即发，心悸少寐；倦怠懒言，唇甲不华

解析：本题考查的是眩晕的辨证论治。气血亏虚所致眩晕的主要特征有动则加剧，神疲乏力（A对）、劳累即发，心悸少寐（B对）与倦怠懒言，唇甲不华（E对）。眩晕是以头晕、眼花为主症的疾病。轻者闭目即止，重者如坐车船，旋转不定，不能站立，或伴恶心、呕吐、汗出、面色苍白等症，甚则突然晕倒。西医学的耳性眩晕（梅尼埃病、耳石症、晕动病）、脑性眩晕（椎-基底动脉供血不足、脑动脉粥样硬化）、颈源性眩晕（椎动脉型颈椎病）以及其他原因（血压异常、神经症、眼部疾患及外伤等）所致眩晕，均可参考此处辨证论治。（一）肝阳上亢证：【症状】眩晕，耳鸣，头目胀痛，口苦，失眠多梦，遇烦劳郁怒而加重，颜面潮红，急躁易怒。舌红苔黄，脉弦或数。（二）气血亏虚证：【症状】眩晕动则加剧，劳累即发，面色淡白，神疲乏力，倦怠懒言，唇甲不华，发色不泽，心悸少寐，纳少腹胀。舌淡苔薄白，脉细弱。（三）肾精不足证：【症状】眩晕日久不愈，精神萎靡，两目干涩，视力减退，腰膝酸软（C错），或遗精滑泄，耳鸣齿摇，颧红咽干，五心烦热。舌红少苔，脉细数。（四）痰湿中阻证：【症状】眩晕，头重昏蒙，或伴视物旋转，胸闷恶心（D错），呕吐痰涎，食少多寐。舌苔白腻，脉濡。